小儿原发性肾病综合征肺脾气虚证的首选方剂是
A. 五苓散
B. 五皮饮
C. 真武汤
D. 杞菊地黄丸
E. 防己黄芪汤

正确答案：E。防己黄芪汤

解析：肺脾气虚证候：全身浮肿，面目为著，小便减少，面白身重，气短乏力，纳呆便溏，自汗出，易感冒，或有上气喘息，咳嗽，舌淡胖，脉细弱。治法：益气健脾，宜肺利水。方药：防已黄芪汤合五苓散加减（E对）。水湿证宜补气健脾，利水消肿。方药：五苓散合己椒苈黄丸加减（A错）。肺脾气虚证若浮肿明显，加五皮饮利水行气。五皮饮行气化湿，利水消肿，用于全身水肿，胸腹胀满，小便不利以及妊娠水肿等（B错）。脾肾阳虚型宜温肾健脾，化气行水。方药：偏肾阳虚，真武汤合黄芪桂枝五物汤加减（C错）。杞菊地黄丸滋肾养肝，用于肝肾阴亏的眩晕、耳鸣、目涩畏光、视物昏花（D错）。